麻仁胶囊处方组成的臣药除大黄外，还有
A. 炒枳实、苦杏仁
B. 炒枳实、姜厚朴
C. 苦杏仁、炒白芍
D. 姜厚朴、炒白芍
E. 苦杏仁、姜厚朴

正确答案：C。苦杏仁、炒白芍

解析：本题考查的是麻仁胶囊的方义简释。麻仁胶囊处方组成的臣药除大黄外，还有苦杏仁、炒白芍（C对）。麻仁胶囊：【方义简释】方中火麻仁甘平油润，香美可口，善润肠通便，故重用为君药。大黄苦寒沉降，清泄通利，善通便泻热；苦杏仁苦泄降，富含脂，温有小毒，药力较强，善降气润肠通便；炒白芍甘补酸敛，苦微寒兼清，善养血敛阴、缓急止痛。三药相合，既增君药润肠通便之功，又清泻肠热，故为臣药。炒枳实（AB错）苦泄降，辛行散，微寒趋平，善破气消积、除痞；姜厚朴（DE错）苦温燥降，辛能行散，善行气消积除满。二药相合，善行胃肠滞气，促进津液输布，以增润肠通便之力，故为佐药。全方配伍，甘润苦降兼清泄，共奏润肠通便之功，故善治肠热津亏所致的便秘，症见大便干结难下、腹部胀满不舒，以及习惯性便秘见上述证候者。